艾司奥美拉唑（埃索美拉唑）是奥美拉唑的S型异构体，其与奥美拉唑的R型异构体之间的关系是
A. 具有不同类型的药理活性
B. 具有相同的药理活性和作用持续时间
C. 在体内经不同细胞色素酶代谢
D. 一个有活性，另一个无活性
E. 一个有药理活性，另一个有毒性作用

正确答案：C。在体内经不同细胞色素酶代谢

解析：本题考查奥美拉唑S-异构体与R-异构体的区别。艾司奥美拉唑（埃索美拉唑）是奥美拉唑的S型异构体，两者在体内经不同细胞色素酶代谢（C对）。R型的5位甲基被药物代谢酶CYP2C19羟基化失活，S型主要被CYP3A4作用，S-异构体比R-异构体在体内的代谢清除率低，经体内循环更易重复循环，维持时间更长，有更优良的药理性质。奥美拉唑的S型异构体与R型异构体疗效一致，具有相同类型的药理活性（ADE错），但S-异构体有更优良的药理性质，有更长的作用持续时间（B错）。